静脉注射给药后，通过提高渗透压而产生利尿作用的药物是
A. 右旋糖酐
B. 氢氧化铝
C. 甘露醇
D. 硫酸镁
E. 二巯基丁二酸钠

正确答案：C。甘露醇

解析：本题考查甘露醇。静脉注射给药后，通过提高渗透压而产生利尿作用的药物是甘露醇（C对）。有些药物是通过简单的化学反应或物理作用而产生药理效应。例如，口服氢氧化铝（B错）、三硅酸镁等抗酸药中和胃酸，可用于治疗胃溃疡；静脉注射甘露醇，其在肾小管内产生高渗透压而利尿；二硫基丁二酸钠（E错）等络合剂可将汞、砷等重金属离子络合成环状物，促使其随尿液排出以解毒。此外，渗透性泻药硫酸镁（D错）和血容量扩张药右旋糖酐（A错）等通过局部形成高渗透压而产生相应的效应。